多个样本率比较χ²检验中，若P≤a，拒绝H₀，接受H₁，所得的结论是
A. 多个样本率全相等
B. 多个总体率全相等
C. 多个样本率不全相等
D. 多个总体率不全相等
E. 多个总体率全不相等

正确答案：D。多个总体率不全相等